患儿，男，2岁，误服水银后，应选用的洗胃液是
A. 鸡蛋清
B. 1：5000高锰酸钾溶液
C. 牛奶与水等量混合
D. 淀粉溶液
E. 生理盐水

正确答案：A。鸡蛋清

解析：本题考查鸡蛋清。误服水银后，应选用的洗胃液是鸡蛋清（A对）。汞是（Hg）一种金属元素，俗称水银，鸡蛋白可吸附砷、沉淀汞，可用于砷、汞等中毒解救。1：5000高锰酸钾溶液（B错）为氧化剂，可破坏生物碱及有机物，常用于巴比妥类、阿片类、士的宁、烟碱、奎宁、毒扁豆碱及砷化物、氰化物、无机磷等药物或毒物中毒。牛奶与水等量混合（C错）可缓和硫酸铜、氯酸盐等化学物质的胃肠道刺激作用。淀粉溶液（D错）对中和碘有效，用于碘中毒洗胃，直至洗出液清澈且不显现蓝色为止。生理盐水（E错）常用于毒物不明的急性中毒；可用于砷化物、硝酸银等药物中毒，与之形成腐蚀性较小的氯化物。